患者小便频数短涩，灼热刺痛，尿中挟砂石，排尿时突然中断，尿道窘迫疼痛，尿中带血。治疗应首选
A. 八正散
B. 石韦散
C. 小蓟饮子
D. 沉香散
E. 无比山药丸

正确答案：B。石韦散

解析：八正散为热淋的选方，功能清热解毒，利湿通淋（A错）。题中患者以小便频数短涩，灼热刺痛为主症，故诊断为淋证，尿中夹砂石为石淋的典型特征。湿热下注，煎熬尿液，结为砂石，故为石淋。砂石随尿排出艰难，故小便频数短涩，灼热刺痛，尿中挟砂石，若砂粒较大，阻塞尿路，则排尿突然中断，并因阻塞不同而致尿道窘迫疼痛，砂石损伤脉络，故尿中带血，故辨为石淋，治宜清热利湿，排石通淋（B对）。小蓟饮子为血淋的选方，功能清热通淋，凉血止血（C错）。沉香散为气淋的选方，功能疏肝理气，利水通淋（D错）。无比山药丸为劳淋的选方，功能健脾益肾（E错）。